不属于重度子痫前期并发症的是
A. 肺炎
B. 脑出血
C. HELLP综合征
D. 急性肾衰竭
E. 弥散性血管内凝血

正确答案：A。肺炎